女，37岁，腹胀腹泻与便秘交替半年，常有午后低热，夜间盗汗。体检：腹壁柔韧感，轻度压痛，肝脾未触及，腹水征（+）。腹水检验：比重1.018，蛋白25g/L。白细胞0.7×10⁹/L，中性0.30，淋巴0.70，红细胞0.3×10⁹/L，本例最可能诊断是
A. 结核性腹膜炎
B. 原发性腹膜炎
C. 癌性腹膜炎
D. 巨大卵巢囊肿
E. 肝静脉阻塞综合征

正确答案：A。结核性腹膜炎

解析：中青年女性患者，有午后低热、夜间盗汗（结核毒血症状）。体检：腹壁柔韧感（结核性腹膜炎的典型体征），轻度压痛。腹水检验：比重1.018，白细胞0.7×10⁹/L，淋巴细胞0.70（结核性腹膜炎腹水比重一般超过1.018，白细胞计数超过500×10⁶/L，以淋巴细胞或单核细胞为主）。综合患者病史、体检与腹水检查，考虑诊断为结核性腹膜炎（A对）。原发性腹膜炎（B错）腹腔内无原发病源，表现为突然发作的急性腹痛，伴恶心、呕吐、发热，全腹肌紧张、压痛、反跳痛。癌性腹膜炎（C错）多见血性腹水，无午后低热、夜间盗汗等结核毒血症状。巨大卵巢囊肿（D错）为常见的卵巢良性肿瘤，无腹水，无结核毒血症状。肝静脉阻塞综合征（九版外科学P429）（E错）表现为双下肢水肿、腹胀、肝脾肿大及胸腹壁静脉曲张。